男，74岁，突发剧烈心前区疼痛，胸闷，气憋，心界向左扩大，心尖区Ⅲ级吹风样收缩期杂音，心率96次/分，律不齐。双肺底湿性哕音。心电图示Ⅰ、aVL、V₅、V₆导联ST段抬高，Ⅰ、aVL导联有异常Q波，室性期前收缩。血清CK-MB200U。对此病人心律失常的治疗应首选
A. 普罗帕酮
B. 维拉帕米
C. 毛花苷丙
D. 利多卡因
E. 苯妥英钠

正确答案：D。利多卡因

解析：患者老年男性，突发剧烈心前区疼痛伴胸闷气憋，心尖区Ⅲ级吹风样收缩期杂音（乳头肌功能失调造成二尖瓣脱垂并关闭不全所致），心电图示：I、aVL、V₅、V₆（提示前侧壁心肌梗死）导联ST段抬高，I、aVL导联有异常Q波（心肌梗死特征性改变），血清CK-MB200U（正常值0～25U，提示升高），故患者应诊断为急性前侧壁心肌梗死。本患者室性期前收缩，心率稍快，故对此病人心律失常的治疗应首选利多卡因（D对）。普罗帕酮（A错）和维拉帕米（B错）可用于急性心肌梗死病人伴室上性心律失常。毛花苷丙（P175）（C错）为洋地黄制剂，最适合用于有快速心室率的心房颤动并心室扩大伴左心室收缩功能不全者，对室性期前收缩患者无多大效果。苯妥英钠（九版药理学P196）（E错）主要用于治疗室性心律失常，为洋地黄所致的室性心律失常的首选用药，亦可用于心肌梗死、心脏手术、心导管术等所致室性心律失常，但并非心肌梗死伴室性期前收缩患者的首选用药。